男，72岁。反酸、烧心36年。近日呼吸困难，乏力2个月。间断口服质子泵抑制剂治疗，起初有效，近2个月效果不佳。胃镜检查示：食管下段及贲门区隆起溃疡性病变，质脆、易出血。最有可能的活组织检查为
A. 淋巴瘤
B. 神经内分泌肿瘤
C. 肠胃间质瘤
D. 鳞癌
E. 腺癌

正确答案：E。腺癌

解析：患者老年男性，长期反酸、烧心。抑酸治疗起初有效，近两个月效果不佳。胃镜检查示：食管下段及贲门区隆起溃疡性病变，质脆、易出血。应该高度怀疑为Barrett食管腺癌，即食管下段长期受到胃酸等刺激产生的癌变，最有可能的活组织检查为腺癌（E对）。淋巴瘤（A错）可累及全身可导致类似表现，但胃镜不会显示食管下段及贲门区隆起溃疡性病变。神经内分泌肿瘤（B错）因肿瘤分泌过多激素可导致胃酸过多，但食管下段因组织结构，一般不产生反流，故不出现相应表现。肠胃间质瘤（C错）常见于胃，表现为圆形肿物，大多数没有完整的包膜，可伴随囊性变，坏死和局灶性出血。鳞癌（D错）虽然为食管癌最常见类型，但是患者为食管下段与胃交界的贲门区病变明显，应考虑Barrett食管腺癌可能性大。